患者，男，16岁，乏力，食欲减退，黄疸进行性加深10天，神志不清1天，体查：明显黄疸，烦躁不安，皮肤瘀斑，肝右肋下未扪及，肝浊音界7～8肋间，扑击样震颤阳性，血清总胆红素255μmol/L，ALT200U/L，凝血酶原活动度28%，诊断应考虑
A. 急性黄疸型肝炎
B. 急性重症肝炎
C. 亚急性重症肝炎
D. 慢性重症肝炎
E. 淤胆型肝炎

正确答案：B。急性重症肝炎

解析：急性重型肝炎的症状，第一，有高度的乏力、纳差、腹胀、厌油腻这种消化道的症状；第二，就是黄疸会进行性的加重，病人有明显的皮肤巩膜黄染、尿色加深、大便颜色变浅；第三，就是凝血功能的障碍，病人可以表现为鼻衄、牙龈出血、皮下的淤点瘀斑等，重的病人可以出现消化道的出血、呕血、便血，甚至是脑出血等脏器的出血的表现。查凝血酶原活动度小于40%，这是诊断急性重型肝炎的一个很客观的、重要的指标，此外病人还可以出现肝性脑病、腹水等严重的并发症。上述表现与患者证候相符，故诊断患者为急性重症肝炎（B对）。